乳腺癌扩大根治术的切除范围包括
A. 乳房及同侧腋窝脂肪淋巴组织
B. 乳房胸大肌胸小肌及其筋膜
C. 乳房胸大肌胸小肌及同侧腋窝脂肪淋巴组织
D. 乳房胸大肌胸小肌及同侧腋窝锁骨上脂肪淋巴组织
E. 乳房胸大肌胸小肌及同侧腋窝胸骨旁脂肪淋巴组织

正确答案：E。乳房胸大肌胸小肌及同侧腋窝胸骨旁脂肪淋巴组织

解析：乳腺癌扩大根治术的切除范围包括乳房、胸大肌、胸小肌及同侧腋窝、胸骨旁脂肪淋巴组织（E对）。乳房、胸大肌、胸小肌及同侧腋窝、锁骨上脂肪淋巴组织（D错）为乳腺癌根治术的切除范围。ABC选项所述并不是规范的乳腺癌手术方式。